非特异性免疫亦称
A. 固有免疫
B. 细胞免疫
C. 主动免疫
D. 被动免疫
E. 体液免疫

正确答案：A。固有免疫

解析：本题考查宿主的抗菌免疫及感染的发生发展。非特异性免疫亦称固有免疫（A对），为生来就有且个体间差异很小的免疫力，可代代遗传，并且是后天特异性免疫的基础。